外感病汗出热退身凉者，表示
A. 表邪入里
B. 阳气衰少
C. 汗出亡阳
D. 真热假寒
E. 邪去正安

正确答案：E。邪去正安

解析：战汗指病人先恶寒战栗而后汗出的症状。外感病汗出热退身凉者，因邪去正复，疾病向愈所致，故表示邪去正安（E对）。表邪入里即凡病表证，表邪不解，内传入里，非上述症状（A错）。阳气衰少以畏冷肢凉、小便清长、面白、舌淡等为主要表现，非上述症状（B错）。汗出亡阳以冷汗、肢厥、面色苍白、脉微等为主要表现，非上述症状（C错）。真热假寒即内有真热而外见假寒的证候，非上述症状（D错）。